哪种体位时颈静脉明显充盈怒张或搏动为异常征象
A. 立位
B. 卧位
C. 坐位或半坐位
D. 侧卧位
E. 以上都不对

正确答案：C。坐位或半坐位

解析：正常人立位、坐位时，颈外静脉不显露，平卧时可见充盈，充盈的水平仅限于锁骨上缘至下颌角距离的下2/3以内。在坐位或半坐位（C对）时，颈静脉明显充盈怒张或搏动为异常征象，提示颈静脉压升高，见于右心衰竭、缩窄性心包炎、心包积液、上腔静脉阻塞综合征，以及胸腔、腹腔压力增加等情况。